在温病辨证中，斑疹隐现属于
A. 卫分证候
B. 气分证候
C. 中焦证候
D. 营分证候
E. 血分证候

正确答案：D。营分证候

解析：营分证，是温病邪热内陷，营阴受损，心神被扰所表现的证。营分证是温热病发展过程中较为深重的阶段。邪热入营，灼伤血络，则斑疹隐隐（D对）。卫分证表现为发热，微恶风寒，舌边尖红，脉浮数（A错）。气分证表现为发热（不恶寒，反恶热），汗出，口渴，舌红苔黄，脉数有力（B错）。中焦病证为温热之邪侵犯中焦脾胃，从燥化或从湿化所表现的证（C错）。血分证以动血、动风、耗阴为主要表现（E错）。